关于蛋及其制品的卫生管理，不正确的是
A. 腐败变质的蛋可以煮熟后食用
B. 蛋类微生物感染在产蛋前后都可能发生
C. 制作蛋制品不得使用腐败变质的蛋
D. 制作皮蛋时注意铅不要超标
E. 皮蛋属于再制蛋

正确答案：A。腐败变质的蛋可以煮熟后食用

解析：本题考查蛋及其制品的卫生管理。鲜蛋的主要卫生问题是致病性微生物（沙门氏菌、金黄色葡萄球菌）和引起腐败变质的微生物污染。污染途径有产蛋前污染和产蛋后污染，蛋类微生物感染在产蛋前后都可能发生（B对）。制作蛋制品不得使用腐败变质的蛋（C对），腐败变质的蛋也不得食用（A错，为本题正确答案），应予销毁。皮蛋属于再制蛋（E对），制作皮蛋时应注意铅的含量（D对），可采用加锌工艺法取代传统工艺，以降低皮蛋内铅含量。